在色谱系统适用性试验中，按公式5.54（tR/Wh/2）2计算所得的结果是
A. 色谱柱的理论板数
B. 分离度
C. 重现性
D. 重复性
E. 拖尾因子

正确答案：A。色谱柱的理论板数